雌激素的生理作用错误的是
A. 促使子宫发育，肌层增厚，血运增加
B. 使子宫内膜增生
C. 加强输卵管节律性收缩的振幅
D. 使宫颈口闭合，黏液减少、变稠，拉丝度减少
E. 促进水、钠潴留

正确答案：D。使宫颈口闭合，黏液减少、变稠，拉丝度减少

解析：雌激素的生理作用：①促进子宫肌细胞增生和肥大，使肌层增厚；增进血运，促使和维持子宫发育；增加子宫平滑肌对缩宫素的敏感性。②使子宫内膜腺体和间质增殖、修复。③使宫颈口松弛、扩张；宫颈黏液分泌增加，性状变稀薄，易拉成丝状。④促进输卵管肌层发育，加强输卵管平滑肌节律性收缩振幅。⑤使阴道上皮细胞增殖和角化，黏膜变厚；增加细胞内糖原含量，使阴道维持酸性环境。⑥使阴唇发育丰满，色素加深。⑦协同FSH促进卵泡发育。⑧通过对下丘脑和垂体的正负反馈调节，控制促性腺激素的分泌。⑨促使乳腺管增生，乳头、乳晕着色。⑩促进水钠潴留。掌握“女性生殖系统生理”知识点。